患者，女，34岁，已婚。经行先后不定，经量多、色红、质稠，少腹胀痛，乳房胀痛，舌暗红、苔薄黄，脉弦。治疗应首选
A. 逍遥散
B. 小柴胡汤
C. 加味逍遥散
D. 血府逐瘀汤
E. 当归芍药散

正确答案：A。逍遥散

解析：患者月经先后不定，称为月经先后无定期。郁怒伤肝，疏泄失常，冲任失调，血海蓄溢无常，故月经先后不定。肝气郁结，冲任瘀阻不畅，故量少，质稠。肝经循行于两胁肋，循乳房，肝气郁结，故两乳胀痛。肝气郁结，郁而化火，故出现苔薄黄，弦脉为肝气郁结之脉象，该患者属月经先后无定期之肝郁证，治宜疏肝理气调经，逍遥散的功效为疏肝解郁，养血健脾，为月经先后无定期肝郁证的首选（A对）。小柴胡汤的功效为和解少阳，主治伤寒少阳证或热入血室证（B错）。加味逍遥散的功效为养血健脾，疏肝清热，用以治疗肝郁血虚，内有郁热者（C错）。血府逐瘀汤的功效为活血化瘀，行气止痛，治疗血瘀证（D错）。当归芍药散用于养血安胎止痛，治疗血虚证（E错）。